血管神经水肿患者当出现喉头水肿，呼吸困难时应该采取以下哪项紧急措施
A. 给泼尼松每日15～30mg，分3次口服
B. 氢化可的松100～200mg，加入5%～10%葡萄糖液1000～2000ml中，静脉滴注
C. 口含冰块或喉部放置冰袋
D. 发生窒息应立即进行气管切开
E. 以上都可

正确答案：E。以上都可

解析：出现喉头水肿，呼吸困难时应密切观察病情发展，并予以糖皮质激素。轻者可给泼尼松每日15～30mg，分3次口服；重症者可给氢化可的松100～200mg，加入5%～10%葡萄糖液1000～2000ml中，静脉滴注；发生窒息应立即进行气管切开。掌握“血管神经性水肿”知识点。